关于药物剂型与疗效关系的说法，错误的是
A. 剂型改变可能会提高药物生物利用度，但不会改变药物作用性质
B. 中药剂型的选择不仅要考虑中药药性，还要考虑活性成分的溶解性
C. 不同给药途径的药物制剂，其药物体内过程及特征也不尽相同
D. 吸入给药的起效速度通常快于肌内注射给药
E. 静脉注射给药的安全性风险通常高于肌内注射给药

正确答案：A。剂型改变可能会提高药物生物利用度，但不会改变药物作用性质

解析：本题考查剂型与疗效关系。1.剂型可改变药物的作用性质多数药物改变给药途径和剂型后，药物的性质不会改变，但有些药物会因剂型或给药途径的改变而改变药物的作用性质（A错，为本题正确答案），如硫酸镁口服制剂为泻下制剂，而静脉注射则为镇静、解痉制剂。（三）剂型选择的原则1.满足药物性质的需要剂型选择需要考虑中药传统药性，包括中药的四气五味、升降沉浮、有毒无毒、性味归经等，还要研究中药制剂所含活性成分的溶解性（B对）、稳定性和刺激性以及生物药剂学和药代动力学性质，综合选择适宜剂型。不同给药途径的药物制剂，由于剂型以及给药途径的影响，药物的体内过程及特征也不尽相同（C对）。通常不同剂型、不同给药方式的药物起效快慢顺序为：静脉注射>吸入给药>肌内注射>皮下注射>直肠或舌下给药>口服液体制剂>口服固体制剂>皮肤给药（D对）。3.剂型可改变药物的安全性中药制剂的使用安全风险的高低顺序通常为静脉注射>肌内注射>口服给药>外用给药（E对）。